"脑溢血"引起对侧躯体偏瘫和感觉障碍的原因可能是
A. 大脑前动脉分支破裂
B. 大脑中动脉分支破裂
C. 大脑后动脉分支破裂
D. 基底动脉分支破裂
E. 大脑交通动脉分支破裂

正确答案：B。大脑中动脉分支破裂

解析：大脑中动脉分支破裂（B对）时，其供应的内囊后肢受损，使经过内囊后肢的丘脑中央辐射（传递对侧躯体感觉）、皮质脊髓束（管理对侧躯体的运动）受损，因而导致对侧偏瘫和感觉障碍。